患者，男，59岁，高血压病史5年，因头痛伴有恶心、呕吐就诊，MRI检查结果显示蛛网膜下腔出血。为防治脑血管痉挛，早期宜选用的药物是
A. 尼莫地平
B. 硝苯地平
C. 氨氯地平
D. 缬沙坦
E. 氢氯噻嗪

正确答案：A。尼莫地平

解析：本题考查防治血管痉挛选用的药物。尼莫地平（A对）是防治脑血管痉挛，早期选用的药物。常用尼莫地平40～60mg，每日4～6次，疗程3周，必要时可静脉应用，应注意其低血压等不良反应。硝苯地平（B错）用于高血压，冠心病，心绞痛。氨氯地平（C错）用于高血压，稳定型心绞痛，变异型心绞痛。缬沙坦（D错）用于轻、中度原发性高血压。氢氯噻嗪（E错）用于水肿性疾病，高血压，中枢性或肾性尿崩症，肾石症。